女，55岁，寒战，发热，右上腹痛15天，体温每日高达39.8℃左右，CT提示肝内两个脓肿，最大直径达6cm，其治疗方法应首选
A. 全身大剂量应用抗生素
B. 右半肝切除术
C. 经皮穿刺置管引流术
D. 脓腔内注入抗生素
E. 支持治疗

正确答案：C。经皮穿刺置管引流术

解析：患者中年女性，寒战，发热，右上腹痛15天，体温每日高达39.8℃（正常腋温36～37℃，提示高热），CT提示肝内脓肿最大直径6cm；由题意可知，患者症状严重，其治疗方法应首选经皮穿刺置管引流术（C对），可有效引流脓液，减轻症状。肝切除术（B错）适用于慢性厚壁肝脓肿、经久不愈等。脓腔内注入抗生素（D错）需在经皮穿刺置管引流术后进行。患者有症状15天后才开始治疗且症状严重，全身大剂量应用抗生素（A错）、继续支持治疗（E错）等非手术治疗效果有限，应作为辅助治疗方法。